代谢性酸中毒时引起心肌收缩力的变化为
A. 先增强后减弱
B. 减弱
C. 增强
D. 先减弱后增强
E. pH降低7.2时，心肌收缩力变化不大

正确答案：A。先增强后减弱

解析：轻度或中度代谢性酸中毒时引起肾上腺髓质释放肾上腺素，从而发挥其对心脏的正性肌力作用，酸中毒严重时又可阻断肾上腺素对心脏作用，而引起心肌收缩力减弱，所以心肌收缩力的变化为先增强后减弱（A对）。